乳头直下，第7肋间隙的穴位是
A. 章门
B. 期门
C. 带脉
D. 京门
E. 日月

正确答案：E。日月

解析：章门位于第11肋游离端下际（A错）。期门位于乳头直下，第6肋间隙，前正中线旁开4寸（B错）。带脉位于侧腹部，第11肋骨游离端直下平脐处（C错）。京门位于侧腰部，第12肋游离端下际处（D错）。日月位于乳头直下，第7肋间隙（E对）。